灭菌前清洁措施包括
A. 手擦洗器械
B. 超声波清洁
C. 高压蒸汽灭菌
D. 去除清洁剂
E. A+B+D

正确答案：E。A+B+D

解析：在器械灭菌与消毒之前，预清洗是必须的步骤，可减少微生物数量；去除血液、唾液以及其他可以阻碍灭菌或消毒效果的物质。具体措施包括手擦洗器械，超声波清洁，去除清洁剂。掌握“口腔器械的消毒与灭菌及医疗废物处理”知识点。